系统性红斑狼疮治疗的基础用药是
A. 硫唑嘌吟
B. 甲氨蝶呤
C. 羟氯喹
D. 环磷酰胺
E. 柳氮磺吡啶

正确答案：C。羟氯喹

解析：大多数SLE（系统性红斑狼疮）患者尤其是在病情活动时需选用免疫抑制剂联合治疗，目前认为羟氯喹（C对）应作为SLE的背景治疗，可在诱导缓解和维持治疗中长期应用。硫唑嘌吟（A错）、甲氨蝶呤（B错）、环磷酰胺（D错）均为免疫抑制剂，但不是系统性红斑狼疮治疗的基础用药。柳氮磺吡啶（E错）为磺胺类抗菌药，常用于溃疡性结肠炎、类风湿关节炎和强直性脊柱炎的治疗